感染霍乱后免疫力为
A. 终生免疫
B. 短期免疫
C. 不获得免疫力
D. 可获得巩固免疫力
E. 免疫力因人而异

正确答案：B。短期免疫